与B7结合抑制T细胞活化的是
A. CD2
B. CD40L
C. ICOS
D. CTLA-4
E. CD28

正确答案：D。CTLA-4